一对年轻夫妇计划出国旅游，出发前，准备选购以下治疗腹泻的药物备用，包括蒙脱石、口服补液盐、双歧杆菌三联活菌、洛哌丁胺，小檗碱。执业药师应熟悉微生态制剂的成分，下列不属于微生态制剂的菌种是
A. 双歧杆菌
B. 嗜酸乳杆菌
C. 粪肠球菌
D. 梭状芽孢杆菌
E. 地衣芽孢杆菌

正确答案：D。梭状芽孢杆菌

解析：本题考查微生态制剂。不属于微生态制剂的菌种是梭状芽孢杆菌（D错，为本题正确答案），梭状芽孢杆菌属于致病菌。微生物制剂常用地衣芽孢杆菌（E对）、双歧杆菌（A对）、嗜酸乳杆菌（B对）、粪肠球菌（C对）等活菌。